关于体循环的描述，错误的是
A. 体循环的动脉干是主动脉
B. 主动脉始于左心室
C. 体循环静脉内流动着静脉血
D. 体循环动脉内含有动脉血
E. 上、下腔静脉收集全身所有组织器官的静脉血

正确答案：E。上、下腔静脉收集全身所有组织器官的静脉血

解析：体循环的动脉干是主动脉（A对）。主动脉始于左心室（B对）。体循环静脉内流动着静脉血（C对）。体循环动脉内含有动脉血（D对）。上、下腔静脉收集全身大部分（E错，为本题正确答案）组织器官的静脉血，心脏由心静脉系收集。